在药品经营过程中，最具特点的职业道德要求是
A. 依法促销，诚信推广
B. 科学严谨，实事求是
C. 保护环境，规范包装
D. 团结协作，尊重同仁
E. 以德为先，尊重生命

正确答案：A。依法促销，诚信推广